仿与原研药品质量和疗效一致的药品注册申请属于
A. 新药申请
B. 补充申请
C. 仿制药申请
D. 进口药品申请

正确答案：C。仿制药申请

解析：本题考查药品注册分类。仿与原研药品质量和疗效一致的药品注册申请属于仿制药申请（C对）。药品分为新药和仿制药。新药由“未曾在中国境内上市销售的药品”调整为“未在中国境内外上市销售的药品”。根据物质基础的原创性和新颖性，将新药（A错）分为创新药和改良型新药。仿制药由“仿已有国家标准的药品”调整为“仿与原研药品质量和疗效一致的药品”。